男，60岁。慢性乙型病毒肝炎病史35年，3次查血甲胎蛋白升高。肝脏触诊无异常。肝功能异常，腹部B超示肝脏内见直径2cm占位性病变。对诊断及治疗最有意义的检查是
A. 腹部增强CT
B. MRCP
C. 放射性核素扫描
D. 腹部CT平扫
E. 腹部X线平片

正确答案：A。腹部增强CT

解析：患者慢性乙型病毒肝炎病史35年（HBV感染是我国肝癌病人的主要病因），3次查血甲胎蛋白升高（甲胎蛋白是诊断肝细胞癌特异性的标志物，广泛用于肝癌的普查、诊断、判断治疗效果及预测复发。在排除妊娠和生殖腺胚胎瘤的基础上，AFP＞400ng/ml为诊断肝癌的条件之一），肝功能异常，腹部B超示肝脏内见直径2cm占位性病变，为明确患者肝癌诊断，腹部增强CT（A对）为最有价值的影像学检查，腹部CT平扫（D错）多为低密度占位，部分有晕圈征，大肝癌常有中央坏死，而增强时动脉期病灶的密度高于周围肝组织，但随即快速下降，低于周围正常肝组织，并持续数分钟，呈“快进快出”表现，故腹部CT平扫敏感性不如增强CT。MRCP（B错）主要用于胆道占位性病变的诊断。放射性核素扫描（C错）对肝癌分辨率较低，临床上已经很少使用。腹部X线平片（E错）对肝癌诊断价值不大。